下列方剂中寓有“阳中求阴”的是
A. 左归丸
B. 右归丸
C. 逍遥散
D. 大补阴丸
E. 金匮肾气丸

正确答案：A。左归丸

解析：左归丸方中重用大熟地滋肾阴，益精髓，以补真阴之不足，为君药。用山茱萸补养肝肾，固秘精气；山药补脾益阴，滋肾固精；龟板胶滋阴补髓；鹿角胶补益精血，温壮肾阳，配入补阴方中，而有“阳中求阴”之义，皆为臣药。枸杞子补肝肾，益精血；菟丝子补肝肾，助精髓；川牛膝益肝肾，强筋骨，俱为佐药（A对）。右归丸的配伍特点为补阳补阴相配，阴中求阳，纯补无泻（B错）。逍遥散配伍特点疏柔合法，肝脾同调，气血兼顾（C错）。大补阴丸配伍特点为甘咸苦寒合方，滋阴培本为主，降火清源为辅（D错）。金匮肾气丸配伍特点重用“三补三泻”，以益精泻浊；少佐温热助阳，以“少火生气”（E错）。